LD₁₀₀是指
A. 绝对致死剂量
B. 最小致死剂量
C. 最大耐受剂量
D. 半数致死剂量

正确答案：A。绝对致死剂量

解析：本题考查LD₁₀₀。LD₁₀₀即绝对致死剂量（A对BCD错），指引起一组受试实验动物全部死亡的最低剂量。